下列各项，不属疔疮走黄原因的是
A. 麻痘余毒未清
B. 误食辛热之品
C. 早期失治
D. 挤压碰撞
E. 过早切开

正确答案：A。麻痘余毒未清

解析：该题考查走黄的病因。麻痘余毒未清易致病情反复，甚至发生邪毒内陷心肝的变证（A错，为正确答案）。误食辛热之品、早期失治、挤压碰撞、过早切开均可致疔毒入营入血，内攻脏腑而成走黄（BCDE对）。